分子中的碱性基团为二甲胺甲基呋喃，药效团为二氨基硝基乙烯的H₂受体阻断药是
A. 罗沙替丁
B. 尼扎替丁
C. 法莫替丁
D. 西咪替丁
E. 雷尼替丁

正确答案：E。雷尼替丁

解析：本题考查雷尼替丁。分子中的碱性基团为二甲胺甲基呋喃，药效团为二氨基硝基乙烯的H₂受体阻断药是雷尼替丁（E对）。雷尼替丁是抗溃疡药，属于组胺H₂受体阻断剂，碱性基团取代的芳杂环为二甲氨甲基呋喃。罗沙替丁（A错）是用哌啶甲苯环代替了雷尼替丁的五元碱性芳杂环。法莫替丁（C错）、尼扎替丁（B错）药物分子中含有噻唑环。西咪替丁（D错）分子中含有咪唑环和氰胍基。